基因表达中的诱导现象是指
A. 阻遏物的生成
B. 细菌利用葡萄糖作碳源
C. 细菌不用乳糖作碳源
D. 由底物的存在引起代谢底物的酶的合成
E. 低等生物可以无限制地利用营养物

正确答案：D。由底物的存在引起代谢底物的酶的合成